外用蚀疮去腐，内服祛痰平喘的药是
A. 砒石
B. 升药
C. 硼砂
D. 大蒜
E. 儿茶

正确答案：A。砒石

解析：本题考查砒石的功效。外用蚀疮去腐，内服祛痰平喘的药是砒石（A对）。砒石【功效】外用蚀疮去腐；内服劫痰平喘，截疟。升药（B错）【功效】拔毒去腐。硼砂（C错）【功效】外用清热解毒，内服清肺化痰。大蒜（D错）【功效】解毒，消肿，杀虫，止痢。儿茶（E错）【功效】收湿敛疮，生肌止血，活血止痛，清肺化痰。